重度铅中毒
A. 有密切铅接触史，尚无临床表现，尿铅或血铅含量增高
B. 铅脑病
C. 有神经衰弱综合征和轻度易兴奋表现
D. 有密切铅接触史，伴神经衰弱综合征，尿铅或血铅正常
E. 有轻度类神经症，尿铅或血铅含量增高，尿ALA含量增高

正确答案：B。铅脑病